男，29岁，烧伤3h，烧伤总面积80%，其中深Ⅱ度30%，Ⅲ度50%，伤后无尿，心率150次/分，呼吸35次/分，伤后头8h输液4500ml（其中胶体800ml）后仍无尿。伤后第8天，体温39.8℃，心率148次/分，呼吸36次/分，创面潮湿，焦痂下积脓，感染向邻近健康组织侵袭，血培养阴性。最可能的原因是
A. 由于大剂量抗生素使用出现假阴性
B. 烧伤创面脓毒症
C. 培养条件不宜细菌生长
D. 烧伤败血症合并脓毒症
E. 脓毒血症

正确答案：B。烧伤创面脓毒症

解析：患者血培养没有出现细菌，说明病变局限在烧伤创面。掌握“火器伤、热烧伤”知识点。